适合牙周病患者清除龈沟附近菌斑的方法是
A. 牙线
B. 牙签
C. 牙间隙刷
D. 水平颤动法刷牙
E. 电动牙刷刷牙

正确答案：D。水平颤动法刷牙

解析：巴斯刷牙法：又称为水平颤动法或龈沟法。作为一种有效的清除龈缘附近以及龈沟内菌斑的方法，巴斯法最为广泛接受，因为这个部位对控制牙龈与牙周感染最为重要。能去除龈缘附近与龈沟内的牙菌斑，特别是邻间区，牙颈部与暴露的根面区，适用于所有人群以及实施过牙周手术的患者。掌握“菌斑控制及提高宿主抵抗力”知识点。